颌骨原发性恶性肿瘤最常见者为
A. 舌癌
B. 骨肉瘤
C. 口腔癌
D. 牙龈癌
E. 原发性骨内鳞状细胞癌

正确答案：B。骨肉瘤

解析：本题考查骨肉瘤。颌骨原发性恶性肿瘤最常见者为骨肉瘤（B对）。骨肉瘤：颌骨原发性恶性肿瘤最常见者为骨肉瘤，也是恶性度较高的原发性骨肿瘤。